《临证指南医案》指出“内风”的机理属于
A. 体内气机的逆乱
B. 体内阴血的不足
C. 体内阳气之变动
D. 诸风掉眩，皆属于肝
E. 体内筋脉的失养

正确答案：C。体内阳气之变动

解析：风气内动，即“内风”，是与外风相对，指脏腑气血失调，体内阳气亢逆而致风动之症的病理变化。凡是在疾病发展过程中，因为阳盛或阴虚不能制阳，阳升无制，出现动摇、眩晕、抽搐、震颤等类似风动的病理状态，都是风气内动的表现。（C对）。